下列关系式中哪项是正确的
A. 灵敏度＋特异度＝1
B. 灵敏度＋阳性预测值＝1
C. 灵敏度＋阴性预测值
D. 灵敏度＋假阴性率＝1
E. 阴性预测值＋阳性预测值＝1

正确答案：D。灵敏度＋假阴性率＝1

解析：本题考查筛检指标的数量关系。灵敏度与假阴性率之间为互补关系，灵敏度＋假阴性率＝1（D对ABCE错）。